与口角糜烂无关的因素
A. B族维生素缺乏，导致营养不良
B. 细菌感染
C. 先天遗传
D. 真菌感染
E. 老年无牙患者，间距缩短

正确答案：C。先天遗传

解析：本题考查与口角糜烂有关的因素。口角炎根据发病原因分为感染性口角炎、创伤性口角炎、接触性口角炎和营养不良性口角炎，所以口角糜烂即口角炎与先天遗传无关（C错，为本题的正确答案）。B族维生素缺乏，尤其是维生素B₂缺乏时间较长导致的营养不良（A对），可发生口角炎。感染性口角炎由细菌（B对）、真菌（D对）、病毒等病原微生物引起。老年无牙患者，颌间垂直距离缩短（E对），唾液易浸渍口角，给白念珠菌、链球菌或葡萄球菌感染提供了有利条件。